百白破疫苗初种的时间
A. 2个月
B. 3个月
C. 8个月
D. 1个月
E. 生后2～3天

正确答案：B。3个月

解析：百白破疫苗的初种年龄是出生后3个月（B对）。